环丙沙星的结构
A. 具有喹啉羧酸结构的药物
B. 具有咪唑结构的药物
C. 具有双三氮唑结构的药物
D. 具有单三氮唑结构的药物
E. 具有鸟嘌呤结构的药物

正确答案：A。具有喹啉羧酸结构的药物

解析：本题考查环丙沙星的结构。环丙沙星结构为1，4-二氢-4-氧代喹啉（或氮杂喹啉）-3-羧酸结构（A对）。具有咪唑结构的药物（B错）有咪康唑、酮康唑等。具有双三氮唑结构的药物有氟康唑（C错）。具有单三氮唑结构的药物有伏立康唑（D错）。具有鸟嘌呤结构的药物有抗病毒药（E错）。